不影响散剂混合质量的因素是
A. 组分的比例
B. 各组分的色泽
C. 组分的堆密性
D. 含易吸湿性组分
E. 组分的吸附性与带电性

正确答案：B。各组分的色泽